女，65岁。颈后部皮肤红肿7天，初起时为小片皮肤硬肿，约3cm×2cm；有多个脓点，随后皮肤肿胀范围增多，出现浸润性水肿，局部皮肤肿胀范围增大，出现浸润性水肿，局部疼痛加重。表面皮肢呈紫褐色，范围约6cm×5cm，T38.9℃，来院就诊。拟手术治疗，不正确的处理方法是
A. 清除化脓或失活的组织
B. 切口线应超过病变边缘
C. 不可一期缝合切口
D. 切口内可填塞纱条
E. 沿皮纹行一横行切口

正确答案：E。沿皮纹行一横行切口

解析：患者老年女性，颈部皮肤红肿，有多个脓点，后出现浸润性水肿，疼痛，表面皮肤呈紫褐色，诊断为颈部痈（痈一般以中、老年发病居多，病变好发于皮肤较厚的部位，如在项部和背部。初起表现为局部小片皮肤硬肿，其中可有数个凸出点或脓点，随后局部病灶的皮肤硬肿范围增大，周围呈现浸润性水肿，局部疼痛加剧，全身症状加重，其间皮肤可因组织坏死呈紫褐色）。患者已出现多个脓点、表面紫褐色，需要及时切开引流，应在静脉麻醉下作“+”或“++”形切口切开引流，而不是沿皮纹行一横行切口（扩大清创范围，并减轻对周围皮肤组织的牵拉）（E错，为本题正确答案），切口线应超过病变边缘皮肤（B对），清除化脓或失活的组织（A对），然后在切口内填塞生理盐水或凡士林纱布（D对），外加干纱布绷带包扎，以后每日更换敷料，等炎症控制后伤口内可用生肌散，促进肉芽组织生长，促进创面收缩愈合，不可一期缝合切口（C对）。